下列不属于第二次卫生革命主攻目标的是
A. 恶性肿瘤
B. 意外伤害
C. 心脑血管系统疾病
D. 精神疾病
E. 寄生虫病和地方病

正确答案：E。寄生虫病和地方病